全麻的准备和诱导麻醉前应做的准备最合理的是
A. 相关的麻醉药品
B. 急救药品
C. 麻醉设备
D. 监护设备
E. 以上都是

正确答案：E。以上都是

解析：全麻的准备和诱导麻醉前应准备好相关的麻醉药品、急救药品、麻醉及监护设备等。掌握“全身麻醉”知识点。